治疗腹痛饮食积滞重症，应首选
A. 保和丸
B. 越鞠丸
C. 枳实导滞丸
D. 枳术丸
E. 木香顺气丸

正确答案：C。枳实导滞丸

解析：保和丸功能消食和胃，为腹痛饮食积滞证轻症的选方，非首选方（A错）。越鞠丸功能行气解郁，主治六郁证，可合枳术丸治疗痞满肝胃不和证（B错）。腹痛饮食积滞证重症治宜消食导滞，理气止痛，首选枳实导滞丸（C对）。枳术丸功能健脾消痞，主治脾虚气滞，饮食停聚证，常合越鞠丸治疗痞满肝胃不和证（D错）。木香顺气散功能疏肝行气，温中化湿，为聚证肝气郁结证的选方（E错）。